某患者有野外操作史，两周后，突发高热、头痛出现皮疹，用变形杆菌OX19株作抗原与患者血清进行外斐试验，抗体效价为1∶320，初步诊断地方性斑疹伤寒，试问是通过哪种媒介传播的
A. 鼠蚤
B. 虱
C. 恙螨
D. 蚊
E. 蜱

正确答案：A。鼠蚤